以芦丁为主要成分的中药是
A. 黄芪
B. 柴胡
C. 姜黄
D. 知母
E. 槐米

正确答案：E。槐米

解析：本题考查的是中药槐米的主要成分。以芦丁为主要成分的中药是槐米（E对）。槐米含有芦丁，槲皮素，皂苷等。其中，芦丁是有效成分。槐米中芦丁的含量高达23.5%，槐花开放后降至13.0%。《中国药典》以总黄酮和芦丁为指标成分对槐米或槐花进行含量测定。要求槐花总黄酮（以芦丁计）不少于8.0%，槐米总黄酮不少于20.0%，对照品采用芦丁；要求芦丁含量，槐花不得少于6.0%，槐米不得少于15.0%。黄芪（A错）的化学成分众多，主要含皂苷类、黄酮类、多糖类及氨基酸类等。黄芪皂苷具有多种生物活性，其中黄芪甲苷是黄芪中主要生理活性成分。《中国药典》以黄芪甲苷和毛蕊异黄酮葡萄糖苷为指标成分进行药材和饮片的含量测定，要求药材含黄芪甲苷不得少于0.080%，饮片含黄芪甲苷不得少于0.060%；要求药材和饮片含毛蕊异黄酮葡萄糖苷少于0.020%。柴胡（B错）中含有的总皂苷为1.6%～3.8%。柴胡中所含皂苷均为三萜皂苷，柴胡皂苷是柴胡的主要有效成分。《中国药典》以柴胡皂苷a和柴胡皂苷d为指标成分对柴胡药材进行含量测定。要求两者的总含量不少于0.30%。知母（D错）中的化学成分主要为甾体皂苷和芒果苷，还含有木脂素、甾醇、鞣质、胆碱等成分。《中国药典》上将知母皂苷BⅡ和芒果苷定为知母药材的质量控制成分，要求知母皂苷BⅡ含量不得少于3.0%，芒果苷的含量不得少于0.7%。姜黄（C错）的化学成分，2022年考试指南未明确说明。姜黄含姜黄素类化合物：姜黄素、双去甲氧基姜黄素、对-羟基桂皮酰阿魏酰基甲烷（去甲氧基姜黄素）、二氢姜黄素。